治疗心脏骤停宜首选
A. 静滴去甲肾上腺素
B. 舌下含异丙肾上腺素
C. 静滴地高辛
D. 肌注可拉明
E. 心内注射肾上腺素

正确答案：E。心内注射肾上腺素

解析：肾上腺素临床应用：①心脏骤停：用于溺水、麻醉和手术过程中的意外、药物中毒、传染病和心脏传导阻滞等所致的心脏骤停。对电击所致的心脏骤停用肾上腺素配合心脏除颤器或利多卡因等除颤。②过敏性疾病。③血管神经性水肿及血清病。④与局麻药配伍及局部止血。⑤治疗青光眼。掌握“肾上腺素”知识点。